女，45岁。突发右上腹疼痛6小时，发病前曾进食油腻食物，伴发热，无寒战，查体：T：39.6℃，P130次/分，BP86/60mmHg神志清楚，巩膜黄染。心肺未见明显异常。右上腹压痛、反跳痛、肌紧张阳性。实验室检查：WBC20×10⁹/L。总胆红素110mol/L，直接胆红素78mol/L。腹部B超提示肝内外胆管扩张。该病人治疗的首要措施是
A. 胆道引流
B. 应用抗生素
C. 保护肝功能
D. 抗休克治疗
E. 解痉镇痛

正确答案：A。胆道引流

解析：中年患者，进食油腻食物后，突发右上腹痛、发热、黄疸（典型的Charcot三联征，提示急性胆管炎），查体：T：39.6℃（正常值为36℃～37℃，提示发热），P130次/分（正常值为60～100次/分，提示心率增快），BP86/60mmHg（正常值为90～140/60～90mmHg，提示血压低），神志清楚，右上腹压痛、反跳痛、肌紧张阳性，实验室检查：WBC20×10⁹/L（正常值为4～10×10⁹/L，提示感染），总胆红素110mol/L（正常值为1.7-17.1µmol/L，明显升高），直接胆红素78mol/L（正常值为 1. 7 -13. 68µmol/L，明显升高），腹部B超提示肝内外胆管扩张（提示胆管梗阻），该患者虽神志清楚，但血压降低，心率增快，最可能的诊断应为急性梗阻性化脓性胆管炎，因此该病人的首要治疗措施为胆道引流（A对），引流后病人情况常能暂时改善，有利于争取时间继续进一步治疗。应用抗生素（B错）、保护肝功能（C错）、抗休克治疗（D错）、解痉镇痛（E错）为一般支持治疗，而非首选措施。